涎石病85％以上发生于
A. 腮腺
B. 下颌下腺
C. 舌下腺
D. 唇腺
E. 腭部小涎腺

正确答案：B。下颌下腺

解析：本题考查涎石病的好发部位。唾液腺结石病又称涎石病，以下颌下腺（B对）发病率最高，约85%左右，原因是下颌下腺管行程较长而弯曲，且斜向前上方走形，唾液在管内运行较慢，导管开口大、位置低，口腔内的牙垢和异物容易进入管内而成为钙盐沉积的核心，进而产生结石。腮腺（A错）发病率仅低于下颌下腺。舌下腺（C错）、唇腺（D错）、腭部小涎腺（E错）很少发生涎石病。